临床上休克最常见的分类方法是按照：
A. 始动环节
B. 发病学原因
C. 血液动力学特点
D. 微循环特点
E. 外周阻力

正确答案：B。发病学原因

解析：临床上休克可按发病学原因（B对ACDE错）将休克分为失血性休克、烧伤性休克、创伤性休克、脓毒性休克、过敏性休克、心源性休克、神经源性休克等。这种分类方法有利于及时认识并清除病因，是目前临床上常用的分类方法。